属于糖皮质激素类平喘药的是
A. 茶碱
B. 布地奈德
C. 噻托溴铵
D. 孟鲁司特
E. 沙丁胺醇

正确答案：B。布地奈德

解析：本题考查糖皮质激素类平喘药。布地奈德（B对）为临床治疗哮喘的糖皮质激素药物。剂型主要为气雾剂或干粉剂。茶碱（A错）为甲基黄嘌呤类平喘药；噻托溴铵（C错）与平滑肌上的M胆碱受体结合，使平滑肌舒张；孟鲁司特（D错）为白三烯调节剂平喘药；沙丁胺醇（E错）为β₂受体激动剂平喘药。